腌腊肉制品类亚硝酸盐（以亚硝酸钠计）的最大残留量是
A. 150mg/kg
B. 50mg/kg
C. 30mg/kg
D. 20mg/kg
E. 15mg/kg

正确答案：C。30mg/kg

解析：本题考查腌腊肉制品类亚硝酸盐（以亚硝酸钠计）的最大残留量。腌腊肉制品类亚硝酸盐（以亚硝酸钠计）的最大残留量是30mg/kg（C对ABDE错）。